可使黏膜着色的含漱液是
A. Dobell′s
B. 1％NaHCO₃
C. 盐水
D. 洗必泰
E. 3％双氧水（稀释2倍）

正确答案：D。洗必泰

解析：本题考查化学药物控制菌斑。洗必泰（D对）是可使黏膜着色的含漱液，长期使用会使牙面、舌背和树脂类修复体的表面着色。Dobell′s（A错）为复方硼酸溶用于冲洗小面积创面与黏膜面或漱口，不会使黏膜着色。1%NaHCO₃（B错）用于治疗念珠菌感染，久用不会使黏膜着色。盐水（C错）无色透明用来冲洗根管或漱口不会使黏膜着色。3%双氧水（稀释2倍）（E错）具有发泡作用可杀菌除臭，也不会使黏膜着色。